一患者，黄疸深，恶心呕吐重，肝脏小，伴昏迷抽搐，有明显胆酶分离现象，应考虑的疾病是
A. 急性病毒性肝炎
B. 肝硬化
C. 胰头癌
D. 急性重症肝炎
E. 肝癌

正确答案：D。急性重症肝炎

解析：病毒性肝炎、急性重症肝炎、肝硬化、肝癌均引起的肝细胞广泛损害，均可发生肝细胞性黄疸，但是出现胆酶分离是肝细胞大量坏死的表现，多提示病情加重，有转为重症肝炎的可能（D对ABE错）；胰头癌为胆汁淤积性黄疸（C错）。